女，21岁。早晨被发现昏睡不醒，枕头旁边有呕吐物。同寝室人有头晕、乏力、恶心症状，房间用煤炉取暖。既往体健。查体：T35.6℃，P100/次，R26次/分BP120/75mmHg。神志不清，双侧曈孔等圆等大，对射存在，心、肺检查未见异常，无颈强直，病理反射未引出。为明确诊断，最有意义的检查是
A. 脑脊液常规检查
B. 头颅CT
C. 血碳氧血红蛋白浓度测定
D. 血及呕吐物毒物检查
E. 全血胆碱酯酶活力测定

正确答案：C。血碳氧血红蛋白浓度测定

解析：早晨被发现昏睡不醒，枕头旁边有呕吐物。同寝室人有头晕、乏力、恶心症状，房间用煤炉取暖（一氧化碳中毒史）。既往体健。查体：T35.6℃，P100/次，R26次/分BP120/75mmHg。神志不清，双侧曈孔等圆等大，对射存在，心、肺检查未见异常，无颈强直，病理反射未引出。根据吸入较高浓度CO的接触史，急性发生的中枢神经损害的症状和体征，结合及时血液COHb测定的结果（C对）按照国家诊断标准，可作出急性CO中毒诊断。